符合单纯型热性惊厥诊断标准的是
A. —次热程中有一次发作
B. 惊厥持续时间＞15分钟
C. 复发总次数＞5次
D. 多为局限性发作
E. 发作1周后EEG检查见棘波、尖波发放

正确答案：A。—次热程中有一次发作

解析：热性惊厥分为单纯型和复杂型两类，其分类意义为：复杂型热性惊厥的癫痫发生率（4-12％）远高于单纯型（2％），因此复杂型热惊的临床表现更加趋近于癫痫（可近似理解为更严重），如惊厥持续时间长﹥10分钟（B错）、一次热程中可多次反复（C错）、呈局限性或全面性发作（D错）、EEG检查可有棘波、尖波发放（E错）。单纯性惊厥：1.全身发作 2.短暂发作 3.一次发热中发作1～2次 4.总次数<=4次 5.单次时间<15分钟。单纯型热惊一次热程中一般只有一次发作（A对），偶有2次；惊厥持续时间长＜10分钟；呈全面性发作。